在下列寡肽和多肽中，生物活性肽是
A. 胰岛素
B. 谷胱甘肽
C. 短杆菌素S
D. 血红素
E. 促胃液素

正确答案：B。谷胱甘肽